女，31岁。反复发作性干咳伴胸闷3年，多于春季发作，无发热咯血及夜间阵发性呼吸困难，多次胸片检查无异常，常用抗生素治疗效果不明显。无高血压病史。全身体检无阳性体征。为明确诊断首选的检查是
A. 胸部CT
B. 心脏超声波
C. 支气管激发试验
D. 动脉血气分析
E. 纤维支气管镜

正确答案：C。支气管激发试验

解析：患者为31岁女性，反复发作性干咳伴胸闷3年，多于春季接触变应原后发作（为支气管哮喘的典型表现），无发热咯血及夜间阵发性呼吸困难，多次胸片检查无异常，抗生素治疗效果不明显，应考虑诊断为支气管哮喘。支气管激发试验（C对）用以测定气道反应性，在吸入支气管激发剂后，如FEV₁下降≥20%，判断结果为阳性，提示存在气道高反应性，气道高反应性是哮喘的基本特征，所以为明确诊断首选支气管激发试验。哮喘发作时，胸部CT（A错）可见两肺透亮度增加，呈过度通气状态，缓解期都无明显异常，故不首选胸部CT。心脏超声波（B错）利用超声的特殊物理学特性检查心脏和大血管的解剖结构及功能状态的一种首选无创性技术，对确诊哮喘无帮助。动脉血气分析（D错）可用于了解哮喘患者的酸碱失调情况，无特异性，对确诊哮喘价值不大。纤维支气管镜（E错）主要用于检查气道、大支气管病变。